尿中常见大量红细胞管型的疾病是
A. 肾结核
B. 肾结石
C. 急性肾盂肾炎
D. 慢性肾小球肾炎
E. 急性肾小球肾炎

正确答案：E。急性肾小球肾炎

解析：本题考查尿中常见大量红细胞管型的疾病。尿中常见大量红细胞管型的疾病是急性肾小球肾炎（E对）。肾结核（A错）均有不同程度的脓尿，可见干酪样碎屑和絮状物。肾结石（B错）可见晶体尿。急性肾盂肾炎（C错）可见白细胞管型。慢性肾小球肾炎（D错）可见颗粒管型。